女，2岁，智能落后，表情呆滞，眼距宽，眼裂小，鼻梁低，口半张，舌伸出口外，皮肤细嫩，肌张力低下，右侧通贯手。最可能的诊断是
A. 唐氏综合征（21-三体综合征）
B. 软骨发育不良
C. 先天性甲状腺功能减低症
D. 佝偻病
E. 苯丙酮尿症

正确答案：A。唐氏综合征（21-三体综合征）

解析：软骨发育不良和佝偻病的患儿智力都正常，所以不能诊断为软骨发育不良（B错）和佝偻病（D错）。虽然唐氏综合征（21-三体综合征）、先天性甲状腺功能减低症、苯丙酮尿症都有智力落后的表现，但每种病都会有其特殊的表征。唐氏综合征（21-三体综合征）最特征的表现是通贯掌。该患儿，出现智能落后、表情呆滞、眼距宽、眼裂小、鼻梁低、口半张、舌伸出口外、皮肤细嫩、肌张力低下、右侧通贯手，符合唐氏综合征（21-三体综合征）的特征，应诊断为唐氏综合征（21-三体综合征）（A对）。先天性甲状腺功能减低症的特殊面容和体态有：皮肤粗糙（唐氏综合征表现为皮肤细嫩）、面色苍黄，毛发稀疏、无光泽，面部黏液水肿、眼睑水肿、眼距宽、鼻梁低平、唇厚，舌大而宽厚、常伸出口外，与该患儿的面容特征不相符，不能诊断为先天性甲状腺功能减低症（C错）。苯丙酮尿症的患儿在出生数月后因黑色素合成不足，头发由黑变黄，皮肤白皙；由于尿液和汗液中排出较多苯乙酸，可有明显鼠尿臭味，该患儿不符合苯丙酮尿症的疾病特征（E错）。